若某一回归直线走向为从左上方走向右下方，则其回归系数b值
A. b＞0
B. b＝0
C. b＜0
D. b＝1
E. 不能确定正负

正确答案：C。b＜0